下列关于促进扩散不正确的是
A. 不消耗能量
B. 无饱和现象
C. 需要载体
D. 无结构特异性
E. 顺浓度梯度

正确答案：B、D。无饱和现象；无结构特异性

解析：本题考查药物的转运方式。促进扩散具有饱和现象（B错，为本题正确答案）和结构特异性（D错，为本题正确答案）；促进扩散是借助载体（C对）进行的顺浓度梯度的转运（E对），不消耗能量（A对）。